哺乳
A. 精子与卵子结合
B. 受精卵女性子宫内孕育成胚胎、胎儿直至分娩的整个过程，即是生育的全过程
C. 胎儿娩出后母亲要哺乳，保证新生儿正常发育成长
D. 计划生育既要控制人口数量，又要提高人口素质
E. 计划生育只要控制人口数量

正确答案：C。胎儿娩出后母亲要哺乳，保证新生儿正常发育成长

解析：本题考查哺乳的概念。哺乳是指胎儿娩出后母亲要哺乳，保证新生儿正常发育成长（C对ABDE错），乳汁中含有丰富的营养，还有一些抵御疾病的特殊抗体。